省级药品监督管理部门依法承担的职责有
A. 对药品零售企业的药品采购行为开展监督检查
B. 对药品批发企业的药品储存行为开展监督检查
C. 对药品生产企业的药品生产行为开展监督检查
D. 对药品上市许可持有人的药品零售行为开展监督检查

正确答案：B、C。对药品批发企业的药品储存行为开展监督检查；对药品生产企业的药品生产行为开展监督检查

解析：本题考查的是药品监督管理部门。省级药品监督管理部门依法承担的职责有对药品批发企业的药品储存行为开展监督检查（B对）与对药品生产企业的药品生产行为开展监督检查（C对）。药品监督管理部门：药品监督管理部门是指依照法律法规的授权和相关规定，承担药品研制、生产、流通和使用环节监督管理职责的组织机构。国家药品监督管理局负责制定药品、医疗器械和化妆品监管制度，负责药品、医疗器械和化妆品研制环节的许可、检查和处罚。省级药品监督管理部门负责药品、医疗器械、化妆品生产环节的许可、检查和处罚，以及药品批发许可、零售连锁总部许可、互联网销售第三方平台备案及检查和处罚。市县两级市场监督管理部门负责药品零售、医疗器械经营的许可、检查和处罚（AD错），以及化妆品经营和药品、医疗器械使用环节质量的检查和处罚。